体重约为出生时2倍的年龄是
A. 3月龄
B. 6月龄
C. 8月龄
D. 10月龄
E. 12月龄

正确答案：A。3月龄

解析：本题考查体重的增长。我国2005年调查资料显示生后3～4月龄（A对BCDE错）的婴儿体重约等于出生体重的2倍；12月龄时体重约为出生体重的3倍。故生后第一年是生后体重增长最快的时期，为第一个生长高峰。生后第二年体重增加约2.5～3kg, 即2岁时体重约达出生体重的4倍（12～13kg）；2岁后至青春前期儿童体重增长减慢但较恒定，年增长值约为2～3kg。